毒物引起一半受试对象死亡所需要的剂量
A. 绝对致死剂量（LD₁₀₀）
B. 最小致死剂量（LD₀₁）
C. 最大耐受剂量（LD₀）
D. 半数致死剂量（LD₅₀）

正确答案：D。半数致死剂量（LD₅₀）

解析：本题考查半数致死剂量（LD₅₀）。半数致死剂量（LD₅₀）（D对ABC错）指毒物引起一半受试对象死亡所需要的剂量。